女，45岁。间断干咳3年，无低热咯血等，反复抗生素治疗无效。查体无明显阳性体征。胸部X线片未见明显异常。最可能的诊断是
A. 支原体肺炎
B. 支气管结核
C. 支气管扩张
D. 咳嗽变异型哮喘
E. 慢性支气管炎

正确答案：D。咳嗽变异型哮喘

解析：患者间断干咳三年，无低热咯血等，反复抗生素治疗无效，查体无明显阳性体征，胸部X线片未见明显异常，考虑为咳嗽变异性哮喘（D对）（患者只有干咳的症状，无其他阳性体征，且抗生素治疗无效）。支原体肺炎（P49）（A错）主要症状为乏力、咽痛、咳嗽、发热等，X线检查示肺部多种形态的浸润影，呈阶段性分布，以肺下野多见，部分患者出现少量胸腔积液，抗生素治疗有效。支气管结核（P65）（B错）会有全身中毒症状如发热盗汗，可有咯血，累及胸膜时可有胸痛。支气管扩张（P37）（C错）多见于青少年，主要表现为持续或反复的咳嗽、咳痰或咳脓痰，听诊时有固定部位的湿啰音，胸部X线检查时，可看到“双轨征”及“环形阴影”。慢性支气管炎（P20）（E错）起病缓慢，病程较长，有长期咳嗽、咳痰史或伴有喘息，抗生素控制感染治疗有效，但本例患者抗生素治疗无效。